导致心肌收缩加强的肾上腺素能受体为
A. α受体
B. β受体
C. β₂受体
D. M受体
E. N₁受体

正确答案：B。β受体